可以碱化尿液，用于代谢性酸中毒的药品是
A. 氯化钾
B. 乳酸钠
C. 谷氨酸
D. 硫酸镁
E. 氯化铵

正确答案：B。乳酸钠

解析：本题考查乳酸钠。乳酸钠（B对）临床适用于代谢性酸中毒，碱化体液或尿液。氯化铵（E错）用于酸化体液或尿液，促进碱性药物的排泄。氯化钾（A错）、谷氨酸（C错）、硫酸镁（D错）均不会改变尿液pH。